下述关于苯妥英钠哪一项是错误的
A. 口服吸收不规则
B. 用于癫痫大发作
C. 用于抗心律失常
D. 用于癫痫小发作
E. 用于坐骨神经痛

正确答案：D。用于癫痫小发作